统计表的基本结构不包括
A. 表号及标题
B. 标目
C. 人称
D. 数字
E. 线条

正确答案：C。人称

解析：统计表的基本结构包括：表号及标题、标目、线条、数字、备注。掌握“统计表和统计图”知识点。